女，31岁，G₃P₁，剖宫产史，因妊娠50天行人工流产负压吸引术，术中患者突感胸闷、头晕、大汗淋漓、下腹坠痛伴恶心。查体:P49次/分，BP90/60mmHg，面色苍白，阴道少量流血。首先应考虑的诊断是
A. 人工流产综合反应
B. 羊水栓塞
C. 子宫穿孔
D. 失血性休克
E. 急性腹膜炎

正确答案：A。人工流产综合反应

解析：中年女性患者，G₃P₁，剖宫产史，因妊娠50天行人工流产负压吸引术，术中患者突感胸闷、头晕、大汗淋漓、下腹坠痛伴恶心。查体：P49次/分（正常值60-100次/分），BP90/60mmHg（正常值90-140/60-90mmHg），面色苍白，阴道少量流血。综合患者的症状、体征和辅助检查，首先应考虑的诊断是人工流产综合反应（A对），指在人流术中或术毕时，部分病人出现心动过缓、心率不齐、血压下降、面色苍白、头晕、胸闷、大汗淋漓，严重者甚至出现晕厥抽搐等迷走神经虚脱的症状。羊水栓塞（B错）多表现为：①血压骤降或心脏骤停；②急性缺氧如呼吸困难、发绀或呼吸停止；③凝血功能障碍或无法解释的严重出血。子宫穿孔（C错）常表现为术者出现子宫无底感，或手术器械进入深度超过原来所测得深度 。失血性休克（D错）时阴道应大量流血。急性腹膜炎（E错）表现为腹膜刺激征：腹部压痛、腹肌紧张和反跳痛。